广义的药物相互作用包括
A. 药物与食物的相互作用
B. 药物与饮料的相互作用
C. 药物与烟、酒的相互作用
D. 药物与诊断试剂的相互作用
E. 化学药与中草药的相互作用

正确答案：A、B、C、E。药物与食物的相互作用；药物与饮料的相互作用；药物与烟、酒的相互作用；化学药与中草药的相互作用